三叉神经第三支属于
A. 运动神经
B. 交感神经
C. 感觉神经
D. 混合神经
E. 分泌神经

正确答案：D。混合神经

解析：本题考查下颌神经。三叉神经包括眼支、上颌支和下颌支。第三支是指下颌支即下颌神经，是以感觉神经为主的混合神经（D对）。眼支（第一支）和上颌支（第二支）都属于感觉神经（C错）。